粮谷类储存时仓库条件何时易于昆虫繁殖
A. 库温为18～21℃，相对湿度在65%以上时
B. 库温为18～21℃，相对湿度在65%以下时
C. 库温为10～18℃，相对湿度在55%以上时
D. 库温为10～18℃，相对湿度在55%以下时
E. 以上都不适宜

正确答案：A。库温为18～21℃，相对湿度在65%以上时